银汞合金充填后，患牙需等待多久后才能咀嚼
A. 3h
B. 6h
C. 12h
D. 24h
E. 48h

正确答案：D。24h

解析：银汞合金：充填完成后嘱患者24小时内，不用该牙咀嚼。掌握“牙体充填材料之银汞合金”知识点。